环甲肌的作用是
A. 开大声门裂
B. 缩小声门裂
C. 紧张声韧带
D. 松弛声韧带
E. 缩小喉口

正确答案：C。紧张声韧带

解析：环甲肌的作用是紧张声韧带（C对）。